女性，农民，烧伤总面积70%，1小时后送入当地卫生院并准备转上级医院治疗，当地卫生院在作医疗处理时应首先考虑
A. 清创后包扎创面转送
B. 准备饮料路上服用
C. 联系运输工具，尽快转院
D. 建立可靠输液途径，准备输液
E. 肌内注射镇痛药

正确答案：D。建立可靠输液途径，准备输液

解析：本题考查火器伤、热烧伤。患者大面积烧伤，应该避免长途转送，必须转送者应建立静脉输液通道，途中继续输液（D对），保证呼吸道畅通。